在X线片上显示髁状突头部一小部分骨折，折断小骨块向前上内移位，称为
A. 一般规律类髁状突骨折
B. 髁状突内弯移位类髁状突骨折
C. 前脱帽类髁状突骨折
D. 髁状突骨折伴前脱位
E. 髁状突嵌入颅中窝

正确答案：C。前脱帽类髁状突骨折

解析：本题考查下颌骨骨折-髁突骨折。前脱帽类髁状突骨折（C对）在X线片上显示为髁突头部一小部分骨折，折断小骨块向前上内移位。一般规律类髁状突骨折（A错）指折断后髁突仍位于关节窝内，骨折断端有移位或无移位，有移位者折断块向前下呈重叠移位。髁状突内弯移位类髁状突骨折（B错）发生于髁颈部，又称中位骨折，髁突骨折后内弯移位，断端成角畸形。髁状突骨折伴前脱位（D错）多发生于髁颈部，骨折后髁突脱位于关节结节下方或前上方。髁状突嵌入颅中窝（E错）极为罕见，可见髁突脱位于颅中窝底。